能补中益气，生津养血的是
A. 党参
B. 蜂蜜
C. 饴糖
D. 红景天
E. 绞股蓝

正确答案：A。党参

解析：本题考查的是党参的功效。能补中益气，生津养血的是党参（A对）。党参：【功效】补中益气，生津养血。蜂蜜（B错）：【功效】补中缓急，润肺止咳，滑肠通便，解毒。饴糖（C错）：【功效】补脾益气，缓急止痛，润肺止咳。红景天（D错）：【功效】益气，平喘，活血通脉。绞股蓝（E错）：【功效】健脾益气，祛痰止咳，清热解毒。